健康对经济发展的作用主要表现在
A. 增强人群健康水平、促进经济发展
B. 促进卫生技术的进步、提高服务质量
C. 提高人群整体素质、增加国民收入
D. 促进社会生产力发展
E. 提高劳动生产率、减少卫生资源消耗

正确答案：E。提高劳动生产率、减少卫生资源消耗

解析：本题考查健康对经济发展的作用。健康对经济发展的作用主要表现在：1.增加劳动力供给；2.提高劳动生产率；3.减少疾病损失和资源耗费（E对ABCD错）；4.促进教育收益实现；5.促进自然资源利用。